简化口腔卫生指数要检查
A. 全口牙
B. 半口牙
C. 前牙唇侧
D. 6颗指数牙
E. 后牙舌侧

正确答案：D。6颗指数牙

解析：简化口腔卫生指数（OHI-S）是Greene和Vermillion对他们在1960年提出的口腔卫生指数（OHI）加以简化，使之更易操作的基础上于1964年提出的。两者的区别在于OHI需检查全口28颗牙，评价12个牙面（每个区段选择覆盖软垢、菌斑与牙石最多的1个唇面，1个舌（腭）面），而OHI-S只检查6个牙面[16、11、26、31的唇（颊）面，36、46的舌面]。简化口腔卫生指数包括简化软垢指数（DI-S）和简化牙石指数（CI-S）。简化口腔卫生指数可以用于个人，但主要用于人群口腔卫生状况评价。掌握“牙周病流行病学及分级预防”知识点。